新生儿缺氧缺血性脑病易出现低血糖，此时应选择的葡萄糖输注速度是每分钟
A. 3～5mg/Kg
B. 6～8mg/Kg
C. 9～11mg/Kg
D. 16～20mg/Kg
E. 12～15mg/Kg

正确答案：B。6～8mg/Kg

解析：新生儿缺氧缺血性脑病易出现低血糖，治疗时应将血糖维持在正常高值，以提高代谢需要的能量，选择的葡萄糖输注速度是每分6-8mg/Kg（B对）。